高效液相色谱中，通常用来含量计算的是
A. 定量限
B. 最大吸收波长
C. 比旋度
D. 规格
E. 峰面积

正确答案：E。峰面积

解析：本题考查高效液相色谱法。高效液相色谱法的定量方法采用标准对照法，以峰高（h）或峰面积（A）（E对）定量，但通常以峰面积定量，只有当色谱峰的拖尾因子（T）在0.95～1.05时，方可用峰高定量。